主要作用于M期，抑制细胞有丝分裂的药物是
A. 放线菌素D
B. 阿霉素
C. 拓扑特肯
D. 依托泊苷
E. 长春碱

正确答案：E。长春碱